下列关于氟西汀的说法正确的是
A. 属5-HT再摄取抑制剂
B. 属多巴胺再摄取抑制剂
C. 属去甲肾上腺素再摄取抑制剂
D. 代谢产物有活性
E. 属于抗抑郁症药

正确答案：A、D、E。属5-HT再摄取抑制剂；代谢产物有活性；属于抗抑郁症药

解析：本题考查5-羟色胺（5-HT）再摄取抑制剂氟西汀。下列关于氟西汀的说法正确的是属5-HT再摄取抑制剂（A对）、代谢产物有活性（D对）、属于抗抑郁症药（E对）。氟西汀为选择性的-羟色胺重摄取抑制剂（SSRI）（BC错），可强烈抑制5-HT的重吸收，提高突触间隙的浓度，能显著改善抑郁症状，以及焦虑和睡眠障碍。氟西汀在胃肠道吸收，在肝脏代谢生成活性的N-去甲基代谢去甲氟西汀，通过肾脏消除。去甲氟西汀与原药活性相同，且半衰期长，有产生药物蓄积及排泄缓慢的现象，肝病和肾病患者需要考虑用药安全问题。